意外事故较多见，营养性疾病亦多见的年龄段是
A. 新生儿期
B. 幼儿期
C. 婴儿期
D. 学龄前期
E. 学龄期

正确答案：B。幼儿期

解析：幼儿期小儿消化系统仍不完善，营养需求量仍然相对较高，易出现营养性疾病，此期小儿对危险的识别和自我保护能力都有限，因此意外伤害发生率非常高，故意外事故较多见，营养性疾病亦多见的年龄段是幼儿期（B对）。新生儿期（A错）小儿因刚脱离母体转而独立生存，适应能力较差，故发病率和死亡率均高。婴儿期（C错）小儿体格生长迅速，需要大量各种营养素，但婴儿的消化系尚未成熟，故易发生消化紊乱和营养性疾病。学龄前期（P28）（D错）小儿智力发展快、独立活动范围广，有一定的自我保护能力，也应当预防溺水、外伤、食物中毒等意外事故。学龄期（P28）（E错）小儿求知欲强，是获得知识和体格发育的重要时期，应预防近视、龋齿等疾病。